对B细胞分化成熟和抗体产生起重要作用的协同刺激信号是
A. CD40-CD40L
B. CD80-CD28
C. CD86-CD28
D. ICAM-1-LFA-1
E. B7-1-CTLA-4

正确答案：A。CD40-CD40L